DNA分子上能被RNA聚合酶特异结合的部位叫作
A. 外显子
B. 增强子
C. 密码子
D. 终止子
E. 启动子

正确答案：E。启动子

解析：真核基因包括编码序列和非编码序列，编码序列有内含子和外显子，非编码序列往往是基因表达的调控区，主要包括启动子、增强子和一些转录调节因子等。外显子（A错）是指出现在成熟mRNA分子上的核酸序列；内含子指会出现在hnRNA中，但剪接过程被除去的核酸序列。启动子（E对）是指DNA分子上能够介导RNA聚合酶结合并形成转录复合体的序列。增强子（B错）是可以增强真核基因启动子工作效率的顺式作用元件。